某大学二年级学生，因爸爸经常在家抽烟，他从高中就开始尝试吸烟，现在每天都会抽上1-2支。新学期一开始，学校就公布了新的奖励制度，明确规定吸烟学生不得授予奖学金和优秀称号。他便成功戒烟。吸烟行为属于
A. 易导致非故意伤害的行为
B. 易导致故意伤害的行为
C. 物质滥用行为
D. 不良饮食和体重控制行为
E. 缺乏体力活动行为

正确答案：C。物质滥用行为